男，28岁。左下肢疼痛6个月，加重1个月。初起长时间行走后加重，休息后可缓解，1个月前起休息时亦觉疼痛。曾间断发生左下肢不同部位红线状病灶。无高血压糖尿病病史，吸烟10年。查体：T36.5℃，P18次／分，BP120/80mmHg，心肺腹未见异常，左足苍白，左足背动脉搏动消失，左股、腘动脉可触及搏动。左下肢病变应首先考虑的诊断
A. 急性动脉栓塞
B. 血栓性浅静脉炎
C. 动脉硬化性闭塞症
D. 深静脉血栓形成
E. 血栓闭塞性脉管炎

正确答案：E。血栓闭塞性脉管炎

解析：男，28岁（青壮年男性）。左下肢疼痛6个月，加重1个月。初起长时间行走后加重，休息后可缓解（间歇性跋行），1个月前起休息时亦觉疼痛（静息痛）。曾间断发生左下肢不同部位红线状病灶（复发性游走性浅静脉炎）。无高血压糖尿病病史（无易致动脉硬化的因素），吸烟10年（多数有吸烟嗜好）。查体：T36.5℃，P18次／分，BP120/80mmHg，心肺腹未见异常，左足苍白，左足背动脉搏动消失，左股、腘动脉可触及搏动（E对）。急性动脉栓塞的临床表现，可以概括为5P ， 即疼痛、感觉异常、麻痹、无脉和苍白（A错）。血栓性浅静脉炎，患肢局部红肿，疼痛，行走时加重，可触及痛性索状硬条或串珠样结节（B错）。动脉硬化性闭塞症有高脂血症、高血压、吸烟、糖尿病、肥胖等高危因素。前期症状为病肢冷感、苍白，进而出现间歇性跋行。后期，病肢皮温明显降低、色泽苍白或发绀，出现静息痛，肢体远端缺血性坏疽或溃疡（C错）。深静脉血栓形成主要表现为一侧肢体突然发生的肿胀，伴有胀痛、浅静脉扩张，都应疑及下肢深静脉血栓形成（D错）。